脊髓颈膨大和腰骶膨大相应的脊髓节段是
A. C6～T4和L4～S3
B. c9～T4和L2～S2
C. c5～T1和L2～S3
D. c6～T1和L5～S3
E. 耻骨棘与坐骨结节连线的中点

正确答案：C。c5～T1和L2～S3

解析：脊髓呈前、后稍扁的圆柱形，全长粗细不等，有两个梭形膨大部。上方的称颈膨大,从第4颈髓节段至第1胸髓节段。下方的称腰骶膨大,从第1腰髓节段至第3骶髓节段（C对）。